男，32岁，突发上腹剧痛2小时，蔓延至右下腹及全腹，既往有“胃痛”病史10余年，未诊治，查体：板状腹，压痛、反跳痛（+），肝浊音界消失，首选的检查方法是
A. 血生化
B. 立位腹部X线平片
C. 血淀粉酶
D. 腹部B超
E. 腹部CT

正确答案：B。立位腹部X线平片

解析：青年男性患者，有胃痛病史，2小时前突发上腹剧痛，腹部压痛、反跳痛，板状腹（腹膜刺激征，提示急性腹膜炎），肝浊音界消失（提示空腔脏器破裂），结合患者病史、体查，应考虑为胃十二指肠溃疡急性穿孔。为明确诊断，首选的检查方法为腹部立位平片（B对）。胃十二指肠溃疡急性穿孔后，肠道内气体进入腹腔，立位时气体积聚于膈下，腹部平片表现为膈下新月状阴影，因此若腹部立位平片发现膈下游离气体影，结合患者病史多可确诊。血生化（A错）主要用于检测血液中的各种离子、糖类、脂类及酶、激素等物质的含量，溃疡穿孔患者的上述生化指标一般变化不大，因此对该患者的诊断意义不大。血淀粉酶（C错）主要用于急性胰腺炎的诊断，溃疡穿孔的患者血淀粉酶可有轻度升高。腹部B超（D错）、腹部CT（E错）主要用于腹腔实质性脏器病变的检查，而对胃十二指肠等空腔脏器显影不佳。